患者女性，25岁，既往体检，体检时发现肝功能正常，抗-HBs阳性，反复查HBV其他血清标志物均为阴性。表示此患者为
A. 乙型肝炎有传染性
B. 乙型肝炎病情稳定
C. 乙型肝炎病毒携带者
D. 乙型肝炎恢复期
E. 对乙型肝炎有免疫力

正确答案：E。对乙型肝炎有免疫力

解析：抗HBs为HBsAg刺激机体所产生的保护性抗体，HBsAg消失后数天至数月，可检测到抗HBs。少数病例HBsAg消失后始终不产生抗自HBsAg消失至抗HBs出现的时期称为“窗口期”。抗HBs阳性见于HBV感染恢复和乙肝疫苗免疫接种成功，对HBV再感染具有保护作用。本例患者既往体健，无肝炎病史，肝功能正常，反复查HBV其他血清标志物均为阴性，而抗-HBs阳性，说明患者既往感染过HBV或乙肝疫苗免疫接种成功，对HBV具有免疫力（E对）。